目前国际上通用的用于筛查儿童肥胖的方法是
A. 年龄别体重
B. 身高标准体重
C. 身高体重指数
D. 皮褶厚度
E. 体重指数（BMI）

正确答案：E。体重指数（BMI）